正常血清总蛋白含量
A. 80～100g/L
B. 45～55g/L
C. 60～80g/L
D. 20～30g/L
E. 40～50g/L

正确答案：C。60～80g/L

解析：正常血清总蛋白含量是60～80g/L（C对）。